参加组成肝门静脉的是
A. 左睾丸静脉
B. 脾静脉
C. 肝静脉
D. 肝门静脉
E. 直肠下静脉

正确答案：B。脾静脉

解析：脾静脉（B对）和肠系膜上静脉参加组成肝门静脉，其在胰颈后面汇合而成。